坏疽性口炎的发病原因可能是
A. 口腔卫生不良
B. 维生素缺乏
C. 局部创伤
D. 病毒感染
E. 细菌感染

正确答案：E。细菌感染

解析：本题考查坏疽性口炎的发病原因。坏死性龈口炎的病原体为梭状杆菌和螺旋体，在局部或全身抵抗力下降时，同时合并产气荚膜杆菌感染，表现为大量坏死组织脱落，也称之为坏疽性口炎（E对D错）。在口腔卫生不良（A错）、营养状况不佳（维生素缺乏）（B错）会使病情加速发展，病情加重，但是单纯的口腔卫生不良、营养状况不佳（维生素缺乏）并不会引起本病。口腔局部创伤（C错）一般引起创伤性溃疡。